“阴脉之海”是指
A. 带脉
B. 任脉
C. 冲脉
D. 阴跷脉
E. 阴维脉

正确答案：B。任脉

解析：任脉可调节全身阴经脉气，故称“阴脉之海”（B对），带脉可约束纵行躯干的诸条经脉（A错），冲脉可涵蓄十二经气血，故称“十二经之海”或“血海”（C错），阴跷脉可调节肢体运动，司眼睑开合（D错），阴维脉可调节六阴经经气（E错）。